治疗哮病之虚哮证，应首选
A. 三子养亲汤
B. 六君子汤
C. 平喘固本汤
D. 金水六君煎
E. 金匮肾气丸

正确答案：C。平喘固本汤

解析：哮病发作期之虚哮证的病机是痰气瘀阻，肺肾两虚，摄纳失常；治宜补肺纳肾，降气化痰，应首选补益肺肾，降气平喘的平喘固本汤（C对）。哮病发作期之风痰哮证治宜祛风涤痰，降气平喘，方选三子养亲汤（A错）。哮病缓解期之肺脾气虚证治宜健脾益气，补土生金，方选六君子汤（B错）。哮病缓解期之肺肾两虚证治宜补肺益肾，方选生脉地黄汤合金水六君煎（D错）。金匮肾气丸功能温补肾阳，合参蛤散可用于治疗喘证虚喘之肾虚不纳证（E错）。